依据心理学的理论和方法对人的心理品质及水平做出的鉴定称为
A. 心理诊断
B. 心理测量
C. 心理测验
D. 心理调查
E. 心理评估

正确答案：E。心理评估

解析：心理评估是依据心理学的理论和方法对人的心理品质及水平所作出的鉴定。所谓心理品质包括心理过程和人格特征等内容，如情绪状态、记忆、智力、性格等。掌握“心理评估概述”知识点。